患者，女，31岁。素患肠痈，连日来右下腹阵阵作痛，口苦便干，宜与大黄配伍使用的药物是
A. 赤芍
B. 白芍
C. 牡丹皮
D. 丹参
E. 当归

正确答案：C。牡丹皮

解析：患者素患肠痈，连日来右下腹阵阵作痛，口苦便干，为痈肿疮毒，应使用清热凉血，活血化瘀的大牡丹皮与大黄配伍，治疗瘀热互结之肠痈初起（C对）。赤芍（A错）的功效是清热凉血，散瘀止痛。白芍（B错）的功效是养血调经，敛阴止汗，柔肝止痛，平抑肝阳。丹参（D错）的功效是活血祛瘀，通经止痛，清心除烦，凉血消痈。当归（E错）的功效是补血活血，调经止痛，润肠通便。